帕金森患者出现震颤麻痹是由于
A. 前庭小脑神经元病变所致
B. 孤束核神经元病变所致
C. 纹状体神经元病变所致
D. 多巴胺神经递质系统功能受损
E. 乙酰胆碱递质系统功能受损

正确答案：D。多巴胺神经递质系统功能受损

解析：帕金森病的病理变化为黑质多巴胺能神经元显著变性丢失、黑质-纹状体多巴胺能通路变性，导致纹状体多巴胺递质水平显著降低，多巴胺对乙酰胆碱（ACh）的拮抗作用减弱，造成ACh系统功能相对亢进，从而表现出肌肉强直、随意运动减少、面部表情呆板、动作缓慢等震颤麻痹症状。因而帕金森病临床表现是由于黑质-纹状体之间的多巴胺神经递质系统功能受损（D对）引起。纹状体神经元病变（C错）及乙酰胆碱递质系统功能受损（E错）是以亨廷顿病为代表的各种舞蹈症的主要病变部位（P290）。前庭小脑神经元病变（A错）常导致共济失调表现。孤束核是一般内脏感觉神经纤维和味觉纤维终止核，孤束核神经元病变（B错）常出现味觉异常。